患者，男性，68岁，右下牙龈癌，拟行颌颈联合根治术+胸大肌、肋骨复合组织瓣修复术。如组织瓣出现血管危象，应采取的措施是
A. 继续观察
B. 静脉滴注低分子右旋糖酐
C. 及时手术探查
D. 头部制动
E. 补足血容量

正确答案：C。及时手术探查

解析：本题考查出现血管危象的处理措施。术后72小时内是游离皮瓣最容易发生血管危象的时期。动物实验及临床观察均发现，皮瓣危象能否抢救成功，取决于对微循环障碍的早期发现和对受损血管的及时探查（C对），切勿延误时机。经验表明，出现血管危象药物治疗是无效的，过多的等待观察，最终将导致手术失败。手术后进行皮瓣监测的目的是及早发现皮瓣灌注受损的征象。目前最常用的方法仍是临床观察，包括观察皮瓣的颜色、温度、充盈状况、针刺出血情况等。